胃大部切除术后病人，发生早期倾倒综合征的最晚时间是餐后
A. 20分钟
B. 50分钟
C. 40分钟
D. 30分钟
E. 10分钟

正确答案：D。30分钟

解析：倾倒综合征是胃大部切除术后的常见并发症，根据进食后出现症状的时间可分为早期和晚期两种类型。早期倾倒综合征常发生于餐后30分钟（D对），主要表现为心悸、出冷汗、乏力、面色苍白，伴恶心、呕吐、腹部绞痛和腹泻。晚期倾倒综合征多发生于餐后2～4小时。